导致少尿型急性肾衰竭的少尿期尿钠增高的原因是
A. 肾小管上皮细胞重吸收钠、水功能障碍
B. 尿液稀释功能减退
C. 尿液浓缩功能增强
D. 醛固酮分泌减少
E. 肾素分泌增多

正确答案：A。肾小管上皮细胞重吸收钠、水功能障碍

解析：导致少尿型急性肾衰竭的少尿期尿钠增高的原因是肾小管上皮细胞重吸收钠、水功能障碍（A对）。